关于病菌致病因素的描述，错误的是
A. 病菌有粘附因子
B. 病菌有荚膜、微荚膜
C. 与病菌的胞外酶有关
D. 与病菌的内、外毒素有关
E. 与病菌侵入的数量并无密切关系

正确答案：E。与病菌侵入的数量并无密切关系

解析：细菌的致病性与细菌的毒力、侵入细菌的数量（E错，为本题正确答案）、细菌的侵入门户与部位以及机体的免疫力密切相关。与细菌毒力相关的主要因素包括侵袭力、毒素（D对）等。与侵袭力有关的物质主要有粘附素（A对）、侵袭性酶（C对）、荚膜等，微荚膜（B对）在致病中的作用类似荚膜。